女性，65岁。冠心病心绞痛史8年，无高血压史，夜间突发心前区疼痛8小时入院，入院时血压为150/90mmHg（20/12kPa），经心电图检查，诊断急性前壁心肌梗死。起病4周后，病人反复低热，左肺底部有湿性啰音，心前区闻及心包摩擦音，此时应考虑并发
A. 肺部感染
B. 急性心包炎
C. 感染性心内膜炎
D. 心肌梗死后综合症
E. 肺栓塞

正确答案：D。心肌梗死后综合症

解析：患者老年女性，夜间突发心前区疼痛8小时，诊断急性前壁心肌梗死。起病4周后，出现低热，左肺底有湿性啰音（肺炎体征），心前区闻及心包摩擦音（急性心包炎特异性体征），此时应考虑并发心肌梗死后综合征（D对）。单纯肺部感染（A错）可出现湿性啰音，但很少见心包摩擦音。急性心包炎（B错）可在心前区闻及心包摩擦音，但很少出现肺部湿性啰音。本例患者同时有肺部感染和急性心包炎体征，且有心肌梗死病史，故最佳答案还是为心肌梗死后综合征。感染性心内膜炎（C错）也可出现长期低热，但会出现心脏可变杂音，一般不会有心包摩擦音。肺栓塞（E错）患者常突发不明原因的呼吸困难及气促，并可伴胸痛、咳血等体征。